患者，男，20岁。昨日起大便泄泻，发病势急，一日5次，小便减少。治疗应首选
A. 上巨虚、太溪、肾俞、命门
B. 足三里、公孙、脾俞、太白
C. 关元、天枢、足三里、冲阳
D. 天枢、上巨虚、阴陵泉、水分
E. 内庭、上巨虚、神阙、中脘

正确答案：D。天枢、上巨虚、阴陵泉、水分

解析：该患者昨日起大便泄泻，发病势急，一日5次，小便减少，故诊断为急性泄泻。治宜除湿导滞，通调腑气，以足阳明、足太阴经穴为主。选取天枢、上巨虚、阴陵泉、水分为主穴（D对）。慢性泄泻中的肾虚加肾俞、命门（A错）。慢性泄泻的主穴，神阙，天枢，足三里，公孙（BC错）。急性泄泻中的湿热加内庭（E错）。